平滑面龋中最易发生龋坏的部位是
A. 咬合面
B. 邻面
C. 根部
D. 牙颈部
E. 窝沟

正确答案：B。邻面

解析：邻面是平滑面龋的高发部位，也是仅次于点隙窝沟的龋易感位点。掌握“龋病的临床表现与分类”知识点。